男，68岁。2型糖尿病病史14年，血压升高7年，视物模糊3年，渐进性水肿1年。BP170/95mmHg。尿RBC（-），尿蛋白3.8g/d，血肌酐182μmol/L，B超示双肾大小正常。最支持以上诊断的检查是
A. 尿渗透压下降
B. 血ASO升髙
C. 眼底检查糖尿病眼底病变Ⅳ期
D. 血IgA正常
E. 肾小球滤过率＜30g/L

正确答案：C。眼底检查糖尿病眼底病变Ⅳ期

解析：老年男性患者，2型糖尿病多年病史，血压升高7年，视物模糊3年（可疑糖尿病视网膜病变），渐进性水肿1年、尿蛋白达肾病综合征范围（＞3.5g/d）、血肌酐轻度升高（正常范围为88～176μmol/L）提示患者可能并发糖尿病肾病，且已进入Ⅳ期。糖尿病肾病与视网膜病变均为糖尿病合并微血管病变，二者可同时或先后出现。若出现糖尿病视网膜病变，提示糖尿病已并发微血管病变，此时肾小球毛细微血管很可能已经受累。因此若发现糖尿病肾病，可支持增殖期（Ⅳ~Ⅵ期）（C对）视网膜病变(PDR）的诊断。尿渗透压下降（A错）多提示肾小管浓缩功能障碍，可见于急性肾衰竭及尿崩症。血ASO升髙（B错）多见于急性肾小球肾炎。血IgA正常（D错）仅可用于排除IgA肾病。肾小球滤过率＜30g/L（E错）提示肾小球滤过功能下降，多见于急慢性肾衰竭，糖尿病肾病Ⅳ期肾小球滤过率可降低，但无特异性。